龋损的前沿位于牙本质的浅层，患牙对于酸甜刺激进入窝洞引起一过性敏感症状，去除刺激后症状随即消失，可以诊断为
A. 浅龋
B. 猛性龋
C. 中龋
D. 静止龋
E. 深龋

正确答案：C。中龋

解析：中龋：龋损的前沿位于牙本质的浅层，患牙在进食冷、热或酸、甜食品时，刺激进入窝洞引起的一过性敏感症状，去除刺激后症状随即消失。掌握“龋病的诊断及鉴别诊断”知识点。